哺乳期妇女患食积证，不宜使用的药物是
A. 麦芽
B. 山楂
C. 莱菔子
D. 谷芽
E. 鸡内金

正确答案：A。麦芽

解析：本题考查的是麦芽的使用注意。哺乳期妇女患食积证，不宜使用麦芽（A对）。麦芽：【使用注意】本品能回乳，故妇女授乳期不宜大量服。山楂（B错）：【使用注意】本品味酸，故胃酸过多者忌服，脾胃虚弱者慎服。莱菔子（C错）：【使用注意】本品辛散耗气，故气虚及无食积、痰滞者慎服。谷芽（D错）为禾本科植物粟的成熟果实经发芽干燥的炮制加工品。其味甘性微温，功效与稻芽相似，食积兼寒者用之为宜。鸡内金（E错）：【使用注意】本品消食化积力强，故脾虚无积滞者慎服。